阿替洛尔在生物学分类系统中属于第Ⅲ类，其特点是
A. 高溶解度、高渗透性
B. 低溶解度、低解离性
C. 低溶解度、低渗透性
D. 低溶解度、高渗透性
E. 高溶解度、低渗透性

正确答案：C。低溶解度、低渗透性

解析：本题考查生物学分类。第Ⅲ类药物为高溶解度、低渗透性（C对）的水溶性分子药物，其体内吸收速率取决于药物渗透率，包括雷尼替丁、阿替洛尔等。